临床牙冠变短，咬合面或者切缘低于正常牙的牙脱位类型为
A. 脱出性脱位
B. 嵌入性脱位
C. 侧向性脱位
D. 牙齿完全脱位
E. 牙根外吸收

正确答案：B。嵌入性脱位

解析：本题考查牙脱位。嵌入性脱位（B对）：牙齿向深部嵌入，临床牙冠变短，其咬合面或切缘低于正常牙。